烟囱的有效高度是指
A. 烟囱本身的高度
B. 烟囱本身的高度和烟气抬升高度之和
C. 烟气抬升高度
D. 烟囱本身的高度的平方
E. 烟囱的高度与烟气上升高度之乘积

正确答案：B。烟囱本身的高度和烟气抬升高度之和

解析：本题考查烟囱的有效高度。烟囱的有效高度是指烟囱本身的高度和烟气抬升高度之和（B对ACDE错）。